下列食品中钙含量最多的是
A. 馒头
B. 牛奶
C. 胡萝卜
D. 大白菜
E. 四季豆

正确答案：B。牛奶